男，40岁。田间劳动时右足底被割破，伤口长2cm，深达肌腱，自行包扎。10天后感乏力、畏光、咀嚼无力、下肢痛，无神经系统疾病史。査体：满面大汗，苦笑脸，张口困难，角弓反张，阵发性四肢痉挛，心肺査体无异常，腹肌强直，无压痛。该患者早期典型的症状是
A. 四肢抽搐
B. 畏光
C. 咀嚼无力
D. 全身乏力
E. 张口困难

正确答案：E。张口困难

解析：患者10天前右足受伤，现苦笑脸，张口困难，角弓反张，阵发性四肢痉挛，应诊断为破伤风（发生在各种创伤后，潜伏期约为7天，典型症状为苦笑脸，张口困难，角弓反张，阵发性四肢痉挛，交感神经过度兴奋如自汗等）。破伤风累及肌肉的顺序为咀嚼肌→面部表情肌→颈肌→背肌→腹肌→四肢肌→膈肌。相应出现的征象为：张口困难、苦笑面容、颈项强直、角弓反张（躯干扭曲呈弓形，结合四肢痉挛）、屈膝半握拳、呼吸停止，最早的典型症状为张口困难（E对）。四肢抽搐为随后出现的表现（A错）。光刺激为引发破伤风症状的诱因，故畏光不是破伤风发作的表现（B错）。全身乏力（D错）、咀嚼无力（C错）均属前驱症状，不属于典型症状。